抗疟的有效成分是
A. 伪麻黄碱
B. 广藿香酮
C. 穿心莲内酯
D. 青蒿素
E. 齐墩果酸

正确答案：D。青蒿素